研究者收集了某地两年三种疾病的死亡率（1/10万），你认为描述资料适宜的统计图是
A. 散点图
B. 普通线图
C. 单式直条图
D. 直方图
E. 复式直条图

正确答案：E。复式直条图